发育毒性不表现为
A. 死胎
B. 变异
C. 生长迟缓
D. 功能发育不全
E. 畸形

正确答案：B。变异